肾水亏乏之咳嗽，多表现为
A. 夜间咳甚
B. 咳声不扬
C. 咳声低微
D. 咳声重浊
E. 天亮咳甚

正确答案：A。夜间咳甚

解析：肾水亏乏之咳嗽，因夜间酉时肾经当令，肾水愈亏，虚热愈盛，虚火灼肺，咳嗽愈甚，多表现为夜间咳甚。（A对）。咳声不扬（B错），痰稠而黄，不易咯出，属热证，多系热邪犯肺、肺津被灼之故。咳声轻清低微（C错），多属虚证，多因久病耗伤肺气，失于宣降所致。咳声重浊（D错），痰白清稀，鼻塞不通，多因风寒袭肺，肺失宣降所致。天亮咳甚（E错）多为脾虚之咳嗽。